某医院2006年全年住院患者总数为10000例，该年已经上报的医院感染病例数为40例，医院感染漏报病例数为10例，则该医院2006年的医院感染漏报率为
A. 0.001
B. 0.004
C. 0.005
D. 0.2
E. 0.25

正确答案：D。0.2